下列哪项不是血小板功能
A. 在创伤处迅速凝集形成止血栓子
B. 融合入血管内皮细胞，保持内皮细胞完整
C. 参与内皮细胞修复
D. 参与血纤维的形成与增多
E. 增加血液的粘稠度

正确答案：E。增加血液的粘稠度